为了防止农药对土壤的污染，对新农药的要求是
A. 低价格、低残留、低毒
B. 低价格、高效、低毒
C. 低价格、高效、低残留
D. 高效、低毒、低残留
E. 低价格、低毒、高效

正确答案：D。高效、低毒、低残留

解析：本题考查新农药的要求。农药的使用是为了控制农作物的病虫害，以达到提高农作物产量的目的。但是，农药的使用也会对土壤造成污染，因此，在使用农药时，应该尽量减少对土壤的污染。首先，要求农药的高效性，这是因为高效的农药可以有效控制病虫害，减少农药的使用量，从而减少对土壤的污染。其次，要求农药的低毒性，这是因为高毒性的农药会对土壤中的微生物造成毒害，从而影响土壤的肥力和农作物的生长。最后，要求农药的低残留性，这是因为高残留性的农药会在土壤中长期存在，从而对土壤中的微生物造成毒害，影响土壤的肥力和农作物的生长。因此，为了防止农药对土壤的污染，对新农药的要求是高效、低毒、低残留（D对ABCE错）。